维持细菌的外形主要靠
A. 细胞壁
B. 菌毛
C. 鞭毛
D. 质粒
E. 细胞膜

正确答案：A。细胞壁

解析：细胞壁主要功能为保持菌体固有形态和维持菌体内外的渗透压。掌握“细菌的大小、形态和基本结构”知识点。